对污染物在大气中的扩散和稀释起着决定性作用的气象因素是
A. 风和湍流
B. 气温
C. 气湿
D. 气压
E. 热辐射

正确答案：A。风和湍流

解析：本题考查风和湍流。对污染物在大气中的扩散和稀释起着决定性作用的气象因素是风和湍流（A对BCDE错）。风是大气中的流动，它可以将污染物从污染源处运至远处，从而实现污染物的扩散。湍流是大气中的混合，它可以将污染物与空气混合，从而实现污染物的稀释。